乙脑的主要传播方式为
A. 母婴传播
B. 蚊虫叮咬
C. 飞沫传播
D. 血液传播
E. 接触传播

正确答案：B。蚊虫叮咬

解析：乙脑是人兽共患的自然疫源性疾病，人与许多动物（如猪、牛、马、羊等）都可成为本病的传染源。乙脑主要通过蚊叮咬而传播（B对）。库蚊、伊蚊和按蚊的某些种都能传播本病，而三带喙库蚊是主要传播媒介。